临产开始的标志，错误的是
A. 规律宫缩
B. 子宫颈管展平
C. 宫颈扩张
D. 见红
E. 胎先露部下降

正确答案：D。见红

解析：见红是指在临产前24～48小时内，因宫颈内口附近的胎膜与该处的子宫壁分离，毛细血管破裂有少量出血，与宫颈管内黏液栓相混并排出的现象。见红是分娩即将开始较可靠的征象，是先兆临产的表现之一，并不是临产的标志（P177）（D错，为本题正确答案）。临产开始的标志为规律且逐渐增强的子宫收缩（A对），持续约30秒，间歇5～6分钟，同时伴随子宫颈管展平（B对）、宫颈扩张（C对）和胎先露部下降（E对），用强镇静药物不能抑制宫缩。